防己的横断面显
A. 菊花心
B. 车轮纹
C. 朱砂点
D. 大理石样花纹
E. 云锦纹

正确答案：B。车轮纹

解析：本题考查的是药材的断面特征。防己的横断面显车轮纹（B对）。药材断面的特征往往与组织结构、细胞内含物有密切的关系。如“菊花心（A错）”是指药材断面维管束与较窄的射线相间排列成细密的放射状纹理，形如开放的菊花，如黄芪、甘草、白芍等；“车轮纹”是指药材断面维管束与较宽的射线相间排列成稀疏整齐的放射状纹理，形如古代木质车轮，如防己、青风藤等；“朱砂点（C错）”是指药材断面散在的红棕色油点，如茅苍术。断面还可以反映出异常构造的特征，如大黄的“星点”（髓部异型维管束）；牛膝与川牛膝的“筋脉点”（同心环点状异型维管束）；何首乌的“云锦状花纹（E错）”（皮部异型维管束）；商陆的“罗盘纹”（同心环型异型维管束）等。大理石样花纹（D错）为槟榔的切面特征。槟榔：药材呈扁球形或圆锥形。表面淡黄棕色或淡红棕色，具稍凹下的网状沟纹，底部中心有圆形凹陷的珠孔，其旁有一明显疤痕状种脐。质坚硬，不易破碎，断面可见棕色种皮与白色胚乳相间的大理石样花纹。气微，味涩、微苦。